用于治疗良性前列腺增生，可降低雄激素水平和缩小前列腺体积的药物是
A. 奥昔布宁
B. 米多君
C. 坦索罗辛
D. 索利那新
E. 非那雄胺

正确答案：E。非那雄胺

解析：本题考查良性前列腺增生症的药物治疗。5α还原酶抑制剂（非那雄胺）（E对）特异性抑制Ⅱ型5α还原酶而发挥作用，抑制前列腺内双氢睾酮水平，达到降低雄激素水平、缩小前列腺体积并提高最大尿流率的作用。